需求者实际利用卫生服务的数量是
A. 卫生服务需求
B. 卫生服务提供
C. 卫生服务需要
D. 卫生服务利用
E. 卫生服务购买

正确答案：D。卫生服务利用

解析：卫生服务利用指需求者实际利用卫生服务的数量（D对），卫生服务需要（C错）和卫生服务需求（A错）均为人们对卫生服务的需要，差异在于前者从客观角度出发，而后者更具有主观性，根据患者的自身承受能力及需要出发，例如一名患者的右手被机器绞断，入院后经检查认为该患者有较大希望经手术及后续康复治疗达到右手功能的较好恢复，此为该患者的卫生服务需要，但该患者认为自身年龄较大，恢复右手功能价值不大，且手术治疗的费用无法承担而想要进行费用更低的截肢手术，此为该患者的卫生服务需求。卫生服务提供（B错）则为构建运行良好的卫生系统的关键因素之一。